属于牙内陷的是
A. 牙中牙
B. 畸形舌侧窝
C. 畸形根面沟
D. 畸形舌侧尖
E. 以上说法均正确

正确答案：E。以上说法均正确

解析：根据牙内陷的深浅程度及其形态变异，临床上可分为畸形舌侧窝、畸形根面沟、畸形舌侧尖和牙中牙。掌握“牙内陷”知识点。